男，30岁，反复干咳3年，间断发作，发作时口服多种抗生素无效，可自行缓解，曾行肺功能检查结果正常，近2周来再次出现咳嗽，凌晨常咳醒，不伴喘息。查体：双肺呼吸音清，未闻及干湿性啰音，胸部X线片未见异常，为明确诊断，首选检查是
A. 支气管激发试验
B. 血lgE检测
C. 胸部CT
D. 心电图
E. 动脉血气分析

正确答案：A。支气管激发试验

解析：患者反复干咳，凌晨常咳醒，发作时口服多种抗生素无效，可自行缓解。考虑咳嗽变异性哮喘。为明确诊断，首选检查是支气管激发试验（A对）。支气管哮喘，是一种以慢性气道炎症和气道高反应性为特征的异质性疾病。临床表现为反复发作的喘息、气急、胸闷或咳嗽等症状，常在夜间及凌晨发作或加重，多数病人可自行缓解或经治疗后缓解。哮喘非发作期体检可无异常发现。对以咳嗽为唯一症状的不典型哮喘称为咳嗽变异性哮喘（CVA）。支气管激发试验（BPT）用于测定气道反应性。